影响微囊中药物释放速度的因素包括
A. 囊壁的厚度
B. 微囊的粒径
C. 药物的性质
D. 微囊的载药量
E. 囊壁的物理化学性质

正确答案：A、B、C、E。囊壁的厚度；微囊的粒径；药物的性质；囊壁的物理化学性质

解析：本题考查影响微囊中药物释放速度的因素。影响微囊中药物释放速率的因素：1.药物的理化性质（C对）；2.囊材的类型及组成：不同的囊材形成的囊壁具有不同的孔隙率和降解性能，常用囊
材形成的囊壁释药速率依次如下：明胶＞乙基纤维素＞苯乙烯-马来酸酐共聚物＞聚酰胺（E对）；3.微囊的粒径（B对）；4.囊壁的厚度（A对）；5.工艺条件；6.释放介质。微囊中药物释放速率与微囊的载药量（D错）无关。